三代头孢菌素用于预防1类手术切口感染属于
A. 无适应证用药
B. 超适应证用药
C. 有禁忌症用药
D. 过度治疗用药
E. 盲目联合用药

正确答案：A。无适应证用药

解析：本题考查无适应证用药。三代头孢菌素用于预防1类手术切口感染属于无适应证用药（A对）。无适应证用药是指在制定治疗方案和开具处方时，药物的适应证与患者病理、病因、病情、临床诊断不相符。1类手术切口通常不需要预防切口感染，如需预防也主要用于预防金黄色葡萄球菌感染，第三代头孢对金黄色葡萄菌无效。超适应证用药（B错）是指用药超越说明书的适应证范围。有禁忌症用药（C错）是指忽略药品说明书的提示及忽略病情和患者的基础疾病。过度治疗用药（D错）是指滥用抗菌药、糖皮质激素、人血白蛋白、二磷酸果糖及肿瘤补助治疗药，还包括无治疗指征盲目补钙等。盲目联合用药（E错）是指联合应用药物而无明确的指证。